治疗月经过少血瘀证，应首选
A. 滋血汤
B. 归肾丸
C. 桃红四物汤
D. 乌药汤
E. 苍附导痰丸

正确答案：C。桃红四物汤

解析：月经过少血瘀证的病机是冲任受阻，血行不畅，经血受阻。治宜活血化瘀，固冲调经，方用补血活血调经的桃红四物汤（C对）。滋血汤（A错）主治月经过少之血虚证；归肾丸（B错）主治肾虚型月经过少；乌药汤主治血海疼痛（D错）。苍附导痰丸（E错）主治月经过少之痰湿证。